关于腹膜的错误叙述是
A. 产生少量的浆液
B. 腹膜腔为一密闭腔隙
C. 有防御功能
D. 为浆膜结构
E. 分壁腹膜和脏腹膜

正确答案：B。腹膜腔为一密闭腔隙

解析：腹膜为浆膜结构（D对），产生少量的浆液（A对），分壁腹膜和脏腹膜（E对），腹膜和腹膜腔内浆液中含有大量巨噬细胞,可吞噬细菌和有害物质，因此有防御功能（C对）,男性腹膜腔为封闭的腔隙，女性腹膜腔则与外界相通（B错，为本题正确答案）。